症见发热盗汗，面赤心烦，口干唇燥，大便干结，小便黄赤，舌红苔黄，脉数者宜用何方
A. 大补阴丸
B. 知柏地黄丸
C. 清骨散
D. 青蒿鳖甲汤
E. 当归六黄汤

正确答案：E。当归六黄汤

解析：“发热盗汗”是由肾阴亏虚不能于心火，虚火伏于阴分，助长阴分伏火，迫使阴液失守所致；“面赤心烦”乃虚火上炎之象；“口干唇燥”是火耗阴津的表现；舌红苔黄，脉数皆内热之象。治宜滋阴泻火，固表止汗，宜选当归六黄汤（E对）-当归、生地黄、黄芩、黄柏、熟地黄各等分，以滋阴、泻火，倍用黄芪，以益气实卫、固表止汗。大补阴丸功用为滋阴降火，主治阴虚火旺证（A错）。知柏地黄丸功用为滋阴降火，主治肝肾阴虚，虚火上炎证（B错）。清骨散功用为清虚热，退骨蒸，主治肝肾阴虚，虚火内扰证（C错）。青蒿鳖甲汤功用为养阴透热，主治温病后期，邪伏阴分证（D错）。